将药物制成不同剂型的目的和意义不包括
A. 改变药物的作用性质
B. 调节药物的作用速度
C. 降低药物的不良反应
D. 改变药物的构型
E. 提高药物的稳定性

正确答案：D。改变药物的构型

解析：本题考查药物剂型的重要性。良好的剂型可以发挥出良好的药效，但剂型不能改变药物的构型（D错，为本题正确答案）。剂型的重要性主要体现在以下几个方面：①可改变药物的作用性质（A对）；②可调节药物的作用速度（B对）；③可降低（或消除）药物的不良反应（C对）；④可产生靶向作用；⑤可提高药物的稳定性（E对）；⑥可影响疗效。